患者足胫下肢先肿，渐至全身，腰以下肿甚，按之凹陷难复，小便短少，舌淡胖，苔白滑，脉濡缓，属于
A. 阴水
B. 阳水
C. 水停证
D. 悬阴
E. 痰证

正确答案：A。阴水

解析：临床上有阳水和阴水之分，阴水多发病缓，水肿先起于足部，腰以下肿甚（A对）。阳水是眼睑头面先肿，上半身肿甚（B错）。水停证是以肢体浮肿，小便不利，或腹大胀满，舌质淡胖为主要表现的证；水停证包括阴水和阳水（C错）。悬饮是以肋间饱满，咳唾引痛，胸闷息促为主要表现的证（D错）。痰证是以痰多、胸闷、呕恶、体胖、包块等为主要表现的证（E错）。